正确描述气管的是
A. 上端平齐第7颈椎
B. 有完整的环行的气管软骨作为支架，以保持其开张状态
C. 位于前纵隔内
D. 沿颈前正中线下行，在平对第4胸椎体下缘处分为左、右主支气管
E. 上端接甲状软骨

正确答案：D。沿颈前正中线下行，在平对第4胸椎体下缘处分为左、右主支气管

解析：沿颈前正中线下行，在平对第4胸椎体下缘处分为左、右主支气管（D对）。气管上端平齐第6颈椎（A错）。气管软骨由14-17个呈C形缺口向后的透明软骨环构成，而不是完整的环行的气管软骨（B错）。气管位于上纵隔内（C错）。气管上端接喉（E错）。